慢性酒精性中毒的震颤谵妄的临床表现是
A. 停酒后出现的急性精神症状群
B. 长期饮酒过程中出现的慢性精神症状群
C. 停酒后缓慢出现的记忆障碍
D. 长期饮酒过程中出现的记忆障碍
E. 长期饮酒过程中出现的行为改变

正确答案：A。停酒后出现的急性精神症状群

解析：停酒后出现的急性精神症状群是慢性酒精性中毒的震颤谵妄的临床表现（A对）。长期饮酒过程中出现的记忆障碍是酒精性痴呆的表现（D错）。